石决明的功效是
A. 平肝通络
B. 平肝养血
C. 平肝安神
D. 平肝息风
E. 平肝潜阳

正确答案：E。平肝潜阳

解析：本题考查的是石决明的功效。石决明的功效是平肝潜阳（E对）。石决明：【功效】平肝潜阳，清肝明目。正天丸：【功能】疏风活血，养血平肝，（B错）通络（A错）止痛。牡蛎：【功效】平肝潜阳，镇惊安神（C错），软坚散结，收敛固涩，制酸止痛。羚羊角：【功效】平肝息风（D错），清肝明目，凉血解毒。